患者，男，63岁，2型糖尿病病史20年，现服用二甲双胍0.5g，一日3次；阿卡波糖0.1g，一日3次；罗格列酮4mg，一日1次。既往高血压病史5年，冠心病病史5年，心功能I级，轻度肾功能不全，长期服用贝那普利、阿司匹林。患者所用药物中，起效较慢，需服用2～3个月方达稳定疗效的是
A. 二甲双胍
B. 阿卡波糖
C. 罗格列酮
D. 贝那普利
E. 阿司匹林

正确答案：C。罗格列酮

解析：本题考查口服降糖药的用药监护。罗格列酮（C对）属于胰岛素增敏剂，其作用机制与特异性激活过氧化物酶体增殖因子激活的γ型受体（PPAR-γ）有关。通过增加骨骼肌、肝脏、脂肪组织对胰岛素的敏感性，提高细胞对葡萄糖的利用而发挥降低血糖的疗效，可明显降低空腹血糖及胰岛素和C肽水平，对餐后血起效缓慢，需要治疗8～12周后评价疗效和剂量调整。